《灵枢·营卫生会》说“昼不精，夜不瞑”，是阴阳的何种关系失调所致？
A. 互根互用
B. 对立制约
C. 交感互藏
D. 阴阳转化
E. 阴阳自和

正确答案：A。互根互用

解析：人与自然界相统一，白天人体阳气随自然界的阴阳变化而旺盛，兴奋功能占主导地位，但须以夜晚充足的睡眠为前提；夜晚人体阴气渐盛，抑制功能占主导地位，但须以白天的充分兴奋为条件。老年人“昼不精，夜不暝”，就是因阴阳双方相互为用的关系失调而致（A对）。阴阳对立，指阴阳”一分为二”，即对待、相反的关系，是事物或现象固有的属性。阴阳对立的形式，通过阴阳之间的相互斗争、相互制约而发挥作用，阴可制约阳，阳能制约阴，所谓“阴则能制阳矣，静则能制动矣”（B错）。阴阳交感，指阴阳二气在运动中相互感应而交合的相互作用（C错）。阴阳转化，指事物的阴阳属性，在一定条件下可以向其相反的方向转化，即属阳的事物可以转化为属阴的事物，属阴的事物可以转化为属阳的事物（D错）。阴阳自和，指阴阳双方自动维持和自动恢复其协调稳定状态的能力和趋势。阴阳自和是阴阳的本性（E错）。